6个月的新生儿，母体检查出疾病，适合的喂养方式
A. 纯母乳喂养
B. 配方奶喂养
C. 母乳+配方奶
D. 母乳+泥状食物
E. 配方奶+泥状食物

正确答案：B。配方奶喂养

解析：本题考查婴儿喂养。6个月的新生儿，母体检查出疾病，适合的喂养方式配方奶喂养（B对）。在不能进行母乳喂养时，配方奶应作为优先选择的乳类来源。